头痛、头晕、疲劳、心悸、耳鸣是
A. 高血压的临床表现
B. 糖尿病的临床表现
C. 高脂血症的临床表现
D. 消化性溃疡的临床表现
E. 支气管哮喘的临床表现

正确答案：A。高血压的临床表现

解析：本题考查高血压的临床表现。头痛、头晕、疲劳、心悸、耳鸣是高血压的临床表现（A对）。高血压的临床表现：头晕、头痛、耳鸣、眼花、乏力、失眠等，有时有心悸和心前区不适感。糖尿病的临床表现（B错）：多食、多饮、多尿和体重下降。高脂血症的临床表现（C错）：头晕、疲劳、胸闷、呼吸急促和心悸。消化性溃疡的临床表现（D错）：反复上腹部的胀痛，烧心，反酸，嗳气，严重的甚至会引起呕血和黑便。支气管哮喘的临床表现（E错）：咳嗽、咳痰、喘息和呼吸困难。